用一项指标对某小学1～6年级的所有孩子进行发育年龄的评价，你认为单独使用哪项指标，能较好地反映每个学生的发育状况
A. 体重年龄
B. 第二性征年龄
C. 牙齿年龄
D. 身高年龄
E. 变声情况

正确答案：C。牙齿年龄